麦角生物碱临床用于
A. 催产
B. 产后子宫复旧
C. 降血压
D. 引产
E. 偏头痛

正确答案：B、E。产后子宫复旧；偏头痛